新生儿20天，其呼吸与脉搏次数比应该是
A. 1：2
B. 1：3
C. 1：4
D. 1：5
E. 1：6

正确答案：B。1：3

解析：新生儿期呼吸为45～40（次/分），脉搏为140～120（次/分），呼吸与脉搏之比为1:3（B对）。1:4（C错）见于学龄前期和学龄期。